对乙酰氨基酚有解热镇痛作用，与其抑制体内的哪种物质有关
A. 肾上腺激素
B. 前列腺素
C. 白三烯
D. 甲状腺激素
E. 环氧酶

正确答案：B。前列腺素

解析：通常认为在中枢神经系统，对乙酰氨基酚抑制前列腺素合成，产生解热镇痛作用，在外周组织对环氧酶没有明显的作用，这可能与其无明显抗炎作用有关。掌握“对乙酰氨基酚、布洛芬、塞来昔布”知识点。